心肌离心性肥大的主要机制是
A. 心肌细胞增生
B. 心肌细胞增粗
C. 肌节串联性增生
D. 肌节并联性增生
E. 以上都不是

正确答案：C。肌节串联性增生

解析：长期存在心肌损伤或负荷增加时，心脏通过心室重塑代偿。心肌肥大属于心室重塑的一种，分为向心性肥大和离心性肥大。离心性肥大时，心肌肌节呈串联性增生，心肌细胞增长，心腔容积增大，虽然心腔容积增大可刺激心肌肌节并联性增生，但肌节串联性增生（C对）是主要的机制。向心性肥大时，心肌肌节呈并联性增生（D错），心肌细胞增粗（B错），心室壁显著增厚。心肌肥大达到一定程度时可出现心肌细胞增生（A错），但不是心肌离心性肥大的主要机制。